具有凉血止血功效的药物是
A. 侧柏叶
B. 仙鹤草
C. 白及
D. 三七
E. 炮姜

正确答案：A。侧柏叶

解析：该题考查侧柏叶的功效。侧柏叶味苦、涩，性寒，归肺、肝、脾经，其功效为凉血止血，化痰止咳（A对）。